下列辅料中属于油性抗氧化剂的有
A. 焦亚硫酸钠
B. 生育酚（维生素E）
C. 叔丁基对羟基茴香醚
D. 二丁甲苯酚
E. 硫代硫酸钠

正确答案：B、C、D。生育酚（维生素E）；叔丁基对羟基茴香醚；二丁甲苯酚

解析：本题考查抗氧剂。常用的油溶性抗氧剂有维生素E（vitamin E）（B对）、叔丁基对羟基茴香醚（BHA）（C对）、2，6-二叔丁基羟基甲苯（BHT）（二丁甲苯酚）（D对）等。